去除四环素的C-6位甲基和C-6位羟基后，使其对酸的稳定性增加，得到高效、速效和长效的四环素类药物是
A. 盐酸土霉素
B. 盐酸四环素
C. 盐酸多西环素
D. 盐酸美它环素
E. 盐酸米诺环素

正确答案：E。盐酸米诺环素

解析：本题考查米诺环素。米诺环素（E对）是四环素脱去6位甲基和6位羟基，同时在7位引入二甲氨基得到的衍生物，对酸稳定。盐酸土霉素（A错）和盐酸四环素（B错）均为天然四环素类药物。多西环素（C错）是土霉素去掉6位羟基得到的产物。美它环素（D错）是土霉素的衍生物。